男性，25岁，车祸伤1小时，查体：脉搏130次/分，血压86/60mmHg，烦躁不安，发绀，严重呼吸困难，皮肤湿冷，左颈胸部皮下捻发感，气管右移，左胸饱满，左肺呼吸音消失，胸片示左肺完全萎陷。急救处理是
A. 抗休克
B. 气管插管
C. 高流量吸氧
D. 呼吸机辅助呼吸
E. 左侧胸膜腔穿刺

正确答案：E。左侧胸膜腔穿刺

解析：男性，25岁，车祸伤1小时，查体：脉搏130次/分，血压86/60mmHg（血压下降，提示腔静脉回流障碍），烦躁不安，发绀，严重呼吸困难，皮肤湿冷（休克，缺氧），左颈胸部皮下捻发感（皮下气肿），气管右移，左胸饱满，左肺呼吸音消失，胸片示左肺完全萎陷（提示左侧胸膜腔压力高于大气压），综上考虑诊断为左侧张力性气胸。张力性气胸是可迅速致死的危急重症，此时应立即减压，故应选左侧胸膜腔穿刺（E对）。